小儿动作发育规律中错误的是
A. 头尾规律
B. 远近规律
C. 左右规律
D. 由不协调到协调
E. 由粗动作到精细动作

正确答案：C。左右规律

解析：小儿发育规律：头尾规律（由上到下）（A对）：先抬头、后抬胸，再会坐、立、行；由近到远（B对）：从臂到手，从腿到脚的活动；由不协调到协调（D对）；先正向动作后反向动作；由粗到细（E对）：从全掌抓握到手指拾取，左右规律不属于小儿动作发育规律（C错，为本题正确答案）。